调查某地区200名女大学生的血清总蛋白含量，其均数为75.7g/L，标准差3.1g，算得95%参考值范围为（69.62，81.78）g/L，则该地区大约有
A. 95%女大学生血清总蛋白含量高于69.62g/L
B. 5%女大学生血清总蛋白含量低于81.78g/L
C. 2.5%女大学生血清总蛋白含量高于69.62g/L
D. 2.5%女大学生血清总蛋白含量高于81.78g/L
E. 5%女大学生血清总蛋白含量低于69.62g/L

正确答案：D。2.5%女大学生血清总蛋白含量高于81.78g/L

解析：均数μ=75.7，标准差σ=3.1，95%参考值范围正态分布算法：μ-1.96σ=69.62，μ+1.96σ=81.78。与题给范围一致，属于正态分布。因此根据正态曲线下面积的分布规律图，97.5%女大学生血清总蛋白含量高于69.62g/L（AC错），97.5%女大学生血清总蛋白含量低于81.78g/L（B错），2.5%女大学生血清总蛋白含量高于81.78g/L（D对），2.5%女大学生血清总蛋白含量低于69.62g/L（E错）。